长期吸雪茄烟和烟斗的人易发生
A. 牙龈癌
B. 舌癌
C. 颊黏膜癌
D. 腭癌
E. 唇癌

正确答案：E。唇癌

解析：本题考查口腔癌。口腔癌的病因是多方面的。其中物理因素是不可忽视的一种。长期吸雪茄烟和烟斗的人会导致唇部长期受高温的刺激，最易发生唇癌（E对）。牙龈癌（A错）、舌癌（B错）、颊黏膜癌（C错）、腭癌（D错）常见于残根、锐利的牙尖、不良修复体等的长期、经常刺激的部位。